治疗伤寒慢性带菌者首选的药物是
A. 氨苄西林
B. 红霉素
C. 氯霉素
D. 磺胺嘧啶
E. 四环素

正确答案：A。氨苄西林

解析：伤寒慢性带菌者（伤寒胆囊炎）的治疗可选用以下治疗措施。下列几种抗生素在胆汁中浓度较高。氯霉素在胆汁中浓度较低，且经肝脏代谢为无活性物质，故不宜用作治疗慢性带菌者（C错）。1、氧氟沙星或环丙沙星。2、氨苄西林或阿莫西林：用于敏感菌株的治疗（A对）。3、合并胆结石或胆囊炎的慢性带菌者，在病原治疗无效时，需作胆囊切除，以根治带菌状态。